国家调整基本药物目录品种和数量的依据有
A. 已上市药品循证医学、药物经济学评价
B. 国家基本药物的应用情况监测和评估
C. 我国基本医疗卫生需求和基本医疗保障水平变化
D. 我国疾病谱的变化

正确答案：A、B、C、D。已上市药品循证医学、药物经济学评价；国家基本药物的应用情况监测和评估；我国基本医疗卫生需求和基本医疗保障水平变化；我国疾病谱的变化

解析：本题考查的是国家基本药物目录的调整。国家调整基本药物目录品种和数量的依据有已上市药品循证医学、药物经济学评价（A对）、国家基本药物的应用情况监测和评估（B对）、我国基本医疗卫生需求和基本医疗保障水平变化（C对）与我国疾病谱的变化（D对）。国家基本药物目录的品种和数量调整应当根据以下因素确定：①我国基本医疗卫生需求和基本医疗保障水平变化；②我国疾病谱变化；③药品不良反应监测评价；④国家基本药物应用情况监测和评估；⑤已上市药品循证医学、药物经济学评价；⑥国家基本药物工作委员会规定的其他情况。